赭石的功效是
A. 平肝潜阳，收敛固涩
B. 平肝潜阳，明目利尿
C. 息风止痉，祛风止痒
D. 平肝潜阳，凉血止血
E. 息风止痉，清热解毒

正确答案：D。平肝潜阳，凉血止血

解析：本题考查的是赭石的功效。赭石的功效是平肝潜阳，凉血止血（D对）。赭石：【功效】平肝潜阳，重镇降逆，凉血止血。牡蛎：【功效】平肝潜阳，镇惊安神，软坚散结，收敛固涩（A错），制酸止痛。蝉蜕：【功效】疏散风热，透疹止痒，明目退翳，息风止痉（C错）。牛黄：【功效】清热解毒，息风止痉（E错），化痰开窍。功效为平肝潜阳，明目利尿（B错）的中药，2022年考试指南未明确说明。